丁香畏
A. 牵牛子
B. 郁金
C. 三棱
D. 五灵脂
E. 海藻

正确答案：B。郁金

解析：本题考查的是十九畏。丁香畏郁金（B对）。十九畏列述了九组十九味相反药，具体是：硫黄畏朴硝（包括芒硝、玄明粉），水银畏砒霜，狼毒畏密陀僧，巴豆（包括巴豆霜）畏牵牛子（A错）（包括黑丑、白丑），丁香（包括母丁香）畏郁金，川乌（包括附子）、草乌畏犀角，芒硝（包括玄明粉）畏三棱（C错），官桂畏石脂，人参畏五灵脂（D错）。海藻（E错）的配伍禁忌属于十八反。十八反列述了三组相反药，分别是：甘草反甘遂、京大戟、海藻、芫花；乌头（川乌、附子、草乌）反半夏、瓜蒌（全瓜蒌、瓜蒌皮、瓜蒌仁、天花粉）、贝母（川贝、浙贝）、白蔹、白及；藜芦反人参、南沙参、丹参、玄参、苦参、细辛、芍药（赤芍、白芍）。